继发性肺结核X线表现多发生在
A. 上叶尖后段
B. 后叶中段
C. 中叶前段
D. 中叶后段
E. 后叶前段

正确答案：A。上叶尖后段

解析：继发性肺结核与原发性肺结核有明显的差异，继发性肺结核有明显的临床症状，容易出现空洞和排菌，X线表现多发生在肺尖或锁骨下，即上叶尖后段（A对）和下叶背段。后叶中段（B错）、中叶前段（C错）、中叶后段（D错）、后叶前段（E错）不是结核病的好发部位，亦无特殊意义。